我国发生的严重急性呼吸衰竭综合征（SARS），很快波及到许多省市，这种发病情况称为
A. 爆发
B. 大流行
C. 季节性升高
D. 周期性流行
E. 长期变异

正确答案：B。大流行

解析：爆发和大流行属于描述疾病流行强度的常用术语，我国发生的SARS，很快波及到许多省市，即疾病迅速蔓延，短时间内跨越省界，属于大流行（B对）：爆发的病例在时间、空间上高度集中，病例多局限于某集体单位或小范围人群中（A错）。季节性、周期性、长期变异均为疾病三间分布中时间分布的特征，季节性升高属于季节性的一种情况，指疾病一年四季均可发生，但在一定月份发病升高（C错）：周期性流行即周期性，指疾病依规律性的时间间隔发生流行（D错）：长期变异是指疾病在一个相当长的时期，疾病的分布状态、感染类型、临床表现等逐渐发生显著的趋势性变化（E错）。